烟草对人体产生成瘾的成分是
A. 一氧化碳
B. 烟尘
C. 焦油
D. 二氧化碳
E. 尼古丁

正确答案：E。尼古丁

解析：烟草对人体产生成瘾的成分是尼古丁（E对）。当依赖形成后突然戒断时，会出现唾液分泌增加、头痛、失眠、易激惹等戒断症状，使吸烟者难以摆脱尼古丁的控制。